除另有规定外，中药糖浆剂每100ml含糖量应不低于
A. 1g
B. 2～5g
C. 10g
D. 20g
E. 60g

正确答案：E。60g